注射用奥沙利铂的溶媒选择要求是
A. 氯化钠注射液稀释
B. 5%葡萄糖注射液稀释
C. 先用乳酸钠注射液溶解，再用氯化钠注射液或5%葡萄糖注射液进一步稀释
D. 先用氯化钠注射液溶解，再用5%葡萄糖注射液进一步稀释
E. 先用氯化钠溶液溶解，再用氯化钠注射液或5%葡萄糖注射液进一步稀释

正确答案：B。5%葡萄糖注射液稀释

解析：本题考查溶媒的选择要求。注射用奥沙利铂的溶媒选择要求是5%葡萄糖注射液稀释（B对）。注射用奥沙利铂的用法与用量如下：静脉滴注，一次130mg/m²，加入5%葡萄糖注射液250～500ml中，输注2～6h，如无主要毒性出现时，每3周（21日）给药1次，疼痛性感觉异常和（或）功能障碍开始出现时，给药量应减少25% (或100mg/m²），如在调整剂量后症状仍持续存在或加重，应停止治疗，不要与氯化钠和碱性溶液混合或通过同一条静脉同时给药。